属于肠溶性包衣材料是
A. 醋酸纤维素
B. 羟丙基甲基纤维素
C. 丙烯酸树脂Ⅱ号
D. 川蜡
E. 邻苯二甲酸二丁酯

正确答案：C。丙烯酸树脂Ⅱ号

解析：本题考查片剂的包衣。丙烯酸树脂类Ⅱ号（C对）属于肠溶性包衣材料；醋酸纤维素（A错）为水不溶性薄膜包衣材料；羟丙基甲基纤维素（B错）为胃溶型薄膜包衣材料；川蜡（D错）为打光剂；邻苯二甲酸二丁酯（E错）为增塑剂。